肾功能衰竭
A. AG增高性代谢性酸中毒
B. AG正常性代谢性酸中毒
C. 两者均有
D. 两者均无
E. 无

正确答案：C。两者均有

解析：肾功能衰竭，可由于磷酸和硫酸排泄障碍引起AG增高型代谢性酸中毒（A对），也可由于肾小管泌H+减少或重吸收HC03-减少而发生AG正常性代谢性酸中毒（B对，故C为本题正确答案）。